关于梅毒下疳，错误的说法是
A. 触痛明显
B. 覆棕黄色薄痂
C. 病损内含病原体
D. 触及如硬币或软骨样
E. 圆形或椭圆形单个溃疡

正确答案：A。触痛明显

解析：本题考查梅毒下疳（硬下疳）。梅毒下疳是梅毒螺旋体在侵入部位引起的无痛性炎症反应（A错，为本题的正确答案）。梅毒下疳初起为小片红斑，以后发展为丘疹或结节，表面发生坏死，形成圆形或椭圆形的单个无痛性溃疡（E对），周边微隆起，基底平坦，呈肉红色，触之有软骨样硬度或较硬（D对），表面有浆液性分泌物，内含大量梅毒螺旋体（C对），传染性极强。唇硬下疳表面有黄色薄痂膜或为光滑面（B对）。